持续性心房颤动是指心房颤动持续时间
A. 大于24小时
B. 大于48小时
C. 大于3个月
D. 大于1个月
E. 大于7天

正确答案：E。大于7天

解析：持续性房颤是指心房颤动持续时间大于7天（E对），非自限性。阵发性房颤为持续时间小于等于7天（常小于等于48小时），能自行终止。长期持续性房颤为持续时间大于等于1年，患者有转复愿望。永久性房颤为持续时间大于1年，不能终止或终止后复发，无转复愿望。房颤的分类第九版内科学相比第七版内科学有较大的改动，现在按照第九版记忆即可。